经接触疫水传播的传染病的流行特征不包括
A. 患者有接触疫水史
B. 发病有一定的地区性和季节性
C. 病例终年不断.
D. 大量易感人群进入疫区，可以引起暴发或流行
E. 对疫水采取措施或加强个人防护后即可控制疾病的发生

正确答案：C。病例终年不断.